患者心悸，心胸憋闷，心痛时作，痛如针刺，唇甲青紫，舌质暗紫，或有瘀斑、瘀点。治疗代表方宜首选
A. 安神定志丸
B. 天王补心丹
C. 苓桂术甘汤
D. 桃仁红花煎
E. 以上都不是

正确答案：D。桃仁红花煎

解析：题中患者以心悸，心胸憋闷为主，诊断为心悸。痛如针刺，唇甲、舌质紫暗等为瘀阻心脉证的表现，治宜活血化瘀，理气通络，代表方为桃仁红花煎（D对）。安神定志丸为心虚胆怯证之心悸的代表方（A错）。天王补心丹为阴虚火旺证之心悸的代表方（B错）。苓桂术甘汤为水饮凌心证之心悸的代表方（C错）。